与散发性先天性甲状腺功能减低症病因无关的是
A. 促甲状腺激素不足
B. 甲状腺发育不全
C. 甲状腺激素合成障碍
D. 甲状腺异位
E. 碘缺乏

正确答案：E。碘缺乏

解析：先天性散发性甲状腺功能减低症可由患儿甲状腺先天性缺陷（如：促甲状腺激素不足（A对）、甲状腺发育不全（B对）、甲状腺激素合成障碍（C对）、甲状腺异位（D对）等引起，碘缺乏（E错，为本题正确答案）为地方性甲状腺肿的常见原因，碘过量可引起具有潜在性甲状腺疾病者发生甲减，也可诱发和加重自身免疫性甲状腺炎。